视觉皮质的血液供应来自
A. 大脑前动脉
B. 大脑中动脉
C. 大脑后动脉
D. 前交通动脉
E. 基底动脉

正确答案：C。大脑后动脉

解析：视觉皮质为位于距状沟上、下方的枕叶皮质，其血液供应来自大脑后动脉（C对）。